治疗中焦虚寒，肝气上逆之巅顶头痛，宜选用
A. 丁香
B. 肉桂
C. 吴茱萸
D. 干姜
E. 花椒

正确答案：C。吴茱萸

解析：该题考查吴茱萸的应用。丁香具有温中降逆，散寒止痛，温肾助阳的功效，常用于治疗胃寒脘腹冷痛，而非头痛（A错）。肉桂具有补火助阳，散寒止痛，温经通脉，引火归元的功效（B错）。吴茱萸的功效为散寒止痛，降逆止呕，助阳止泻，主入肝经，主治厥阴头痛，即颠顶头痛（C对）。干姜具有温中散寒，回阳通脉，温肺化饮的功效（D错）。花椒具有温中止痛，杀虫止痒的功效，常用于治疗虫积腹痛（E错）。